根据《药品经营质量管理规范》，药品零售企业购进首营品种应
A. 质量审核
B. 专柜存放
C. 质量复核
D. 抽样检验
E. 抽样送检

正确答案：A。质量审核

解析：本题考查药品经营管理。根据《药品经营质量管理规范》，药品零售企业购进首营品种应质量审核（A对）。